哪些人群发生医院感染的危险性大
A. 妊娠期妇女
B. 术后患者
C. 老年人和婴幼儿
D. 糖尿病患者
E. 青壮年

正确答案：C。老年人和婴幼儿